用于验光配镜屈光度检查前散瞳的药物是
A. 聚乙二醇滴眼液
B. 硫酸阿托品眼用凝胶
C. 雷珠单抗注射液
D. 毛果芸香碱滴眼液
E. 丙美卡因滴眼液

正确答案：B。硫酸阿托品眼用凝胶

解析：本题考查眼科疾病用药的分类。硫酸阿托品眼用凝胶（B对）属于散瞳药。聚乙二醇滴眼液（A错）属于治疗干眼症的药物。雷珠单抗注射液（C错）属于治疗视网膜黄斑变性的药物。毛果芸香碱滴眼液（D错）属于治疗青光眼的药物。丙美卡因滴眼液（E错）属于局麻药。